子宫内膜异位症最常见的发病部位是
A. 直肠
B. 膀胱
C. 卵巢
D. 输卵管
E. 阴道

正确答案：C。卵巢

解析：子宫内膜异位症是指子宫内膜组织出现在子宫体以外的部位。异位内膜可侵犯全身任何部位，如脐、膀胱（B错）、肾、输尿管、肺、胸膜、乳腺，甚至手臂、大腿等处，但绝大多数位于盆腔脏器和壁腹膜，以卵巢（C对）和宫骶韧带最常见。